具有抗催乳素作用的药物是
A. 米非司酮
B. 三苯氧胺
C. 溴隐亭
D. 环磷酰胺
E. 雌二醇

正确答案：C。溴隐亭

解析：目前常用的抗催乳素类药物为溴隐亭（C对），为多巴胺受体激动剂，通过与垂体多巴胺受体结合，直接抑制垂体PRL分泌，恢复排卵；溴隐亭还可直接抑制垂体分泌PRL的肿瘤细胞生长，适用于高催乳激素血症、垂体催乳素肿瘤患者。米非司酮（A错）为抗孕激素类药物。三苯氧胺（B错）为抗雌激素药物。环磷酰胺（D错）为抗肿瘤药和免疫抑制剂。雌二醇（E错）为甾体雌激素。